遗传毒理学试验成组应用的配套原则不包括
A. 包括体细胞和性细胞的试验
B. 在反映同一遗传学终点的多种试验中应尽可能选择体外试验
C. 包括多个遗传学终点
D. 包括体内试验和体外试验
E. 包括原核生物和真核生物的试验

正确答案：B。在反映同一遗传学终点的多种试验中应尽可能选择体外试验